某男性，50岁，身高159cm，体重73kg，其营养治疗的首要原则为
A. 限制脂肪摄入量
B. 少油低盐膳食
C. 减少精制糖的摄入
D. 控制总能量的摄入
E. 低胆固醇膳食

正确答案：D。控制总能量的摄入

解析：本题考查肥胖营养治疗的首要原则。本题中该男性身高159cm，体重73kg，BMI＝73（kg）/[1.59m]²＝28.9kg/m²，属于肥胖。其营养治疗的首要原则为控制总能量的摄入（D对ABCE错）。